肺分流一般不易引起PaCO₂增高是由于:
A. 气道阻力
B. CO₂弥散＞O₂弥散力
C. 分流血液中CO₂通过肺泡排出
D. 肺通气增加;
E. 碳酸酐酶活性增加。

正确答案：B。CO₂弥散＞O₂弥散力

解析：肺分流一般不易引起PaCO₂增高是由于CO₂弥散＞O₂弥散力（B对）。